乳果糖治疗肝性脑病的作用机制是
A. 促进肝细胞再生
B. 抑制肠道细菌增殖
C. 吸附肠内毒素
D. 减少肠内氨的形成和吸收
E. 供给糖，以提供热量

正确答案：D。减少肠内氨的形成和吸收

解析：乳果糖是一种合成的双糖，口服后在小肠不被分解（不能分解为葡萄糖以提供热量）（E错），到达结肠后可被乳酸杆菌、粪肠球菌等细菌分解为乳酸、乙酸而降低肠道的pH值。肠道酸化后对产尿素酶的细菌生长不利，但有利于不产尿素酶的乳酸杆菌生长（B错），使肠道细菌产氨减少；此外，酸性的肠道环境可减少氨的吸收（D对），并促进血液中氨渗入肠道排出体外。促进肝细胞再生（A错）为促肝细胞生长素的作用。吸附肠内毒素（C错）为人工肝的作用机制。